关于医疗机构处方调剂和审核的说法，错误的是
A. 药师调剂处方时必须做到“四查十对”：查处方，对科别、姓名、年龄；查药品，对药名、剂型、规格、数量；查配伍禁忌，对药品性状、用法用量；查用药合理性，对临床诊断
B. 药师应当凭医师处方调剂处方药品，非经医师调配的处方不得擅自调剂
C. 处方规范性审核包括处方用药与诊断是否相符，选用剂型与给药途径是否适宜，是否存在配伍禁忌
D. 药师审核处方时，对超剂量的处方应当拒绝调配，必要时，经处方医师更正或者重新签字方可调配

正确答案：C。处方规范性审核包括处方用药与诊断是否相符，选用剂型与给药途径是否适宜，是否存在配伍禁忌

解析：本题考查的是处方审核内容。关于医疗机构处方调剂和审核的说法错误的是处方规范性审核包括处方用药与诊断是否相符，选用剂型与给药途径是否适宜，是否存在配伍禁忌（C错，为本题正确答案）。处方适宜性审核包括处方用药与诊断是否相符，选用剂型与给药途径是否适宜，是否存在配伍禁忌。药师调剂处方时必须做到“四查十对”：查处方，对科别、姓名、年龄；查药品，对药名、剂型、规格、数量；查配伍禁忌，对药品性状、用法用量；查用药合理性，对临床诊断（A对）。药师应当凭医师处方调剂处方药品，非经医师处方不得擅自调剂（B对）。药师审核处方时，对有配伍禁忌或者超剂量的处方应当拒绝调配，必要时，经处方医师更正或者重新签字方可调配（D对）。